兼有抑菌作用的鼻用减充血剂是
A. 呋麻滴鼻液
B. 赛洛唑啉滴鼻液
C. 羟甲唑啉鼻喷剂
D. 麻黄碱滴鼻液
E. 左氧氟沙星滴鼻液

正确答案：A。呋麻滴鼻液

解析：本题考查鼻用减充血剂。兼有抑菌作用的鼻用减充血剂是呋麻滴鼻液（A对）。呋麻滴鼻液除抑菌外，还可使鼻黏膜血管收缩，缓解急、慢性鼻炎的鼻塞症状。赛洛唑啉滴鼻液（B错）用以减轻急慢性鼻炎、鼻窦炎、过敏性鼻炎、肥厚性鼻炎等疾病引起的鼻塞症状。羟甲唑啉鼻喷剂（C错）为α-肾上腺素能受体激动药，具有收缩鼻黏膜血管的作用，减轻充血，从而改善鼻塞症状。适用于急慢性鼻炎、鼻窦炎、过敏性鼻炎、肥厚性鼻炎。麻黄碱滴鼻液（D错）用于缓解鼻黏膜充血肿胀引起的鼻塞。